1型糖尿病的主要特点是
A. 多见于40岁以上的成年人
B. 易发生糖尿病酮症酸中毒
C. 与免疫介导的胰岛B细胞增生有关
D. 早期常不需要胰岛素治疗
E. 多数患者表现为胰岛素抵抗

正确答案：B。易发生糖尿病酮症酸中毒

解析：1型糖尿病绝大多数是自身免疫性疾病，某些外界因素作用于有遗传易感性的个体，激活T淋巴细胞介导的一系列自身免疫反应，引起选择性胰岛B细胞破坏（C错）和功能衰竭，体内胰岛素分泌不足进行性加重，最终导致糖尿病（P734）。因此1型糖尿病病人多于青年期起病，以青少年患者居多，其胰岛素分泌量绝对不足，易发生糖尿病酮症酸中毒（B对），患者起病初期往往需要胰岛素治疗（D错）。2型糖尿病多见于40岁以上成年人（A错），早期多以生活方式治疗及口服降糖药物治疗为主，多不需要胰岛素治疗，胰岛素抵抗（E错）为其主要发病机制。